女，25岁，月经周期为30天，其末次月经是2002年4月18日，其排卵日期大约在5月
A. 2日
B. 4日
C. 6日
D. 8日
E. 10日

正确答案：B。4日

解析：该青年女性末次月经是2002年4月18日，月经周期为30天，则下次月经时间是2002年5月18日，排卵多发生在下次来潮前14日左右，排卵日期大约在2002年5月4日（B对）。